在疾病的三级预防中，若疾病因子还没有进入环境之前就采取预防性措施，称为
A. 第一级预防
B. 第二级预防
C. 第三级预防
D. 根本性预防
E. 以上均不属于

正确答案：D。根本性预防

解析：在第一级预防中，如果在疾病的因子还没有进入环境之前就采取预防性措施，则称为根本性预防掌握“预防医学概论、健康及三级预防策略”知识点。